治疗泄泻脾胃虚弱证，应首选的方剂是
A. 葛根芩连汤
B. 参苓白术散
C. 理中丸
D. 黄芪建中汤
E. 补中益气汤

正确答案：B。参苓白术散

解析：脾胃虚弱证之泄泻为脾虚失运，清浊不分所致，治宜健脾益气，化湿止泻，方用参苓白术散（B对）。葛根芩连汤为湿热伤中证之暴泻的代表方（A错）。在本题基础上，若脾阳虚衰，阴寒内盛，可用理中丸以温中散寒（C错）。黄芪建中汤温中散寒，和胃止痛，治疗脾胃虚寒之胃痛（D错）。在此题基础上，若久泻不止，中气下陷，或兼有脱肛者，可用补中益气汤以益气健脾，升阳止泻（E错）